亚慢性毒性试验对动物的要求是
A. 成年动物
B. 大鼠100g左右，小鼠15g左右
C. 大、小鼠，狗，家兔均可用
D. 必须为啮齿动物或非啮齿动物

正确答案：B。大鼠100g左右，小鼠15g左右

解析：本题考查亚慢性毒性试验对动物的要求。亚慢性毒性试验一般要求选择两种实验动物，一种为啮齿类，另一种为非啮齿类，如大鼠和狗，以便全面了解受试物的毒性特征。由于亚慢性毒性试验期较长，所以被选择的动物体重（年龄）应较小，如小鼠应为15g左右，大鼠100g左右（B对ACD错）。